成人腮腺管口位置一般在
A. 上颌第一磨牙牙冠相对的颊黏膜上
B. 上颌第二磨牙牙冠相对的颊黏膜上
C. 上颌第三磨牙牙冠相对的颊黏膜上
D. 上颌第一前磨牙牙冠相对的颊黏膜上
E. 上颌第二前磨牙牙冠相对的颊黏膜上

正确答案：B。上颌第二磨牙牙冠相对的颊黏膜上

解析：上颌第二磨牙牙冠相对的颊黏膜上有腮腺管口。上颌第三磨牙也是临床寻找腭大孔的标志。掌握“腮腺咬肌区、腮腺与面神经解剖关系”知识点。